上颌动脉的分支有
A. 脑膜中动脉
B. 大脑中动脉
C. 脊髓前动脉
D. 脊髓后动脉
E. 舌动脉

正确答案：A。脑膜中动脉

解析：脑膜中动脉（A对）为上颌动脉的分支。其向上穿棘孔进入颅腔，分为前、后两支，紧贴颅骨的内面走行，分布于颅骨和硬脑膜。